腹膜的作用为
A. 分泌、吸收、修复、再生等功能
B. 形成脏器的外膜
C. 形成腹腔
D. 形成不规则的潜在密闭间隙
E. 形成腹膜腔

正确答案：E。形成腹膜腔

解析：腹膜有分泌、吸收、修复、保护、支持和固定脏器等功能(A错)，腹膜为覆盖在脏器表面的浆膜而不是脏器的外膜(B错)，腹腔为膈以下、小骨盆上口以上及腹壁围成的腔(C错)，形成的潜在性腔隙为腹膜腔(E对)，男性腹膜腔密闭而女性腹膜腔通过输卵管腹腔口，经输卵管、子宫、阴道与外界相通(D错)。